促进钙吸收的物质是
A. 乳糖
B. 维生素C
C. 膳食纤维
D. 维生素E
E. 硒

正确答案：A。乳糖